细胞免疫缺陷的患者易感染
A. 葡萄球菌、链球菌、革兰阴性杆菌
B. 葡萄球菌、链球菌、革兰阳性球菌
C. 放线菌、真菌、病毒
D. 衣原体、支原体、病毒
E. 真菌、病毒、衣原体、支原体

正确答案：C。放线菌、真菌、病毒